对颞下颌关节患者的现病史问诊中，以下除外的是
A. 疾病持续的时间
B. 疾病的原因
C. 是否进行过治疗
D. 是否有药物过敏
E. 治疗的效果

正确答案：D。是否有药物过敏

解析：现病史一般包括主诉疾病开始发病的时间、原因、发展进程和曾经接受过的检查和治疗。对导致牙体缺损、牙列缺损或缺失、颞下颌关节病等疾病的原因，持续时间以及进行过何种修复，修复的次数及其修复效果如何都要进行详细记录。而是否有药物过敏史属于既往史的内容。掌握“修复学病史采集”知识点。